男，2岁，面色苍白半年，易疲乏，精神不集中。时而烦躁纳差，异食癖，查体：皮肤及唇口腔黏膜苍白，肝脾肋下2指。实验室检查：Hb86g/L，RBC3.0×10¹²/L，MCV65，MCHC0.25为明确诊断，需做的实验室检查是
A. 血清铁总铁结合力、转铁蛋白饱和度
B. 血镁
C. 血钙
D. 血常规
E. DNA检测

正确答案：A。血清铁总铁结合力、转铁蛋白饱和度

解析：营养型缺铁性贫血时，血清铁含量降低，总铁结合力升高，转铁蛋白蛋白饱和度降低，应进一步检查以明确诊断（A对）。其他选项与缺铁性贫血的诊断无关（BCDE错）。